患者从高处跌下已3小时，左腰部受伤疼痛剧烈，血尿。查体：BP80/60mmHg，左腰部触痛明显，腹部压痛，无反跳痛，其治疗方法是
A. 输液抗感染
B. 卧床休息
C. 手术治疗
D. 输血
E. 镇痛

正确答案：A。输液抗感染

解析：患者高空跌落后出现左腰部疼痛剧烈、触痛明显、血尿，应怀疑左肾损伤。血压80/60mmHg提示患者发生失血性休克。失血性休克的治疗原则为立刻补充血容量输液以及抗感染治疗（A对）、补充血容量以恢复血压，保证脑等重要脏器的血液灌注，同时观察生命体征。若在补充血容量后血压仍不稳定，说明仍有出血，需手术治疗（C错）。输血的指证是HB小于70才可考虑输血（D错）、待休克纠正后，可采用卧床休息（B错）、镇痛（E错）等一般治疗措施。